第二乳磨牙早失、第一恒磨牙萌出不足，应选择
A. 带环（全冠）丝圈保持器
B. Nance腭弓式间隙保持器
C. 远中导板保持器
D. 充填式保持器
E. 可摘式功能性保持器

正确答案：C。远中导板保持器

解析：本题考查乳牙早失及间隙管理。远中导板保持器（C对）适应证：第二乳磨牙早失、第一恒磨牙尚未萌出或萌出不足。